下列肺部疾病中，引起咯血最常见的疾病
A. 肺结核
B. 肺淤血
C. 肺梗塞
D. 肺吸虫病
E. 肺真菌病

正确答案：A。肺结核

解析：喉及喉部以下的呼吸道及肺任何部位的出血，经口腔咯出称为咯血，引起咯血常见肺部疾病有肺结核、肺炎、肺脓肿等，其中引起咯血最常见的疾病是肺结核（A对）。